男，38岁。患肝硬化3年。一周来畏寒发热，体温38℃左右，全腹痛，腹部明显膨胀，尿量500ml/日。以下体征中对目前病情判断最有意义的是
A. 全腹压痛及反跳痛
B. 蜘蛛痣及肝掌
C. 腹部移动性浊音阳性
D. 脾肿大
E. 腹壁静脉曲张呈海蛇头样

正确答案：A。全腹压痛及反跳痛

解析：中年男性患者，肝硬化3年，腹部明显膨胀（提示有腹水明显增多），一周来畏寒发热，体温38℃左右，全腹痛（提示有感染），尿量500ml/日（正常为1000～2000ml/日，提示尿量减少），综合患者的病史、查体，可初步诊断为肝硬化合并自发性细菌性腹膜炎。自发性腹膜炎最具特征性的体征为腹膜刺激征。因此，对目前病情判断最有意义的应该是全腹压痛及反跳痛（A对）。蜘蛛痣及肝掌（B错）为肝硬化肝功能减退的表现；腹部移动性浊音阳性（C错）、脾肿大（D错）、腹壁静脉曲张呈海蛇头样（E错）均为肝硬化门静脉高压的表现，对于诊断肝硬化合并自发性细菌性腹膜炎无明显意义。